下列关于内源性感染的论述中，正确的是
A. 长期滥用广谱抗生素
B. 慢性肝炎等晚期患者
C. 常发生在应用大剂量免疫抑制剂
D. 来自于患者自身的机会致病微生物
E. 以上说法均正确

正确答案：E。以上说法均正确

解析：内源性感染：感染来自于患者自身的机会致病微生物，常常发生在应用大剂量免疫抑制剂、抗肿瘤化疗药物及放射治疗的患者，长期滥用广谱抗生素以及AIDS、肿瘤和慢性肝炎等晚期患者。掌握“医院感染及细菌的致病性”知识点。